患者男性，50岁。心绞痛病史半年，近1周轻度活动即发作，疼痛程度加重，每次发作持续时间约20分钟，心电图示ST段下移，T波倒置。应首先考虑的诊断是
A. 变异型心绞痛
B. 恶化型劳累性心绞痛
C. 稳定型劳累性心绞痛
D. 初发型劳累性心绞痛
E. 急性心肌梗死

正确答案：B。恶化型劳累性心绞痛

解析：患者有心绞痛病史半年，近1周轻度活动即发作，疼痛程度加重，说明为劳累型心绞痛。患者近1周轻度活动即发作，疼痛程度加重，每次发作持续时间约20分钟，心电图示ST段下移，T波倒置，所以应首先考虑的是恶化型劳累性心绞痛（B对）。休息状态下发作心绞痛或较轻微活动即可诱发，发作时表现为ST段抬高的变异型心绞痛（A错）。稳定型劳累性心绞痛主要是疼痛，是由体力劳累、情绪激动或其他足以增加心肌需氧量的情况所诱发，并且疼痛发作的性质、频率、部位、程度和持续时间在1～3个月内无改变。疼痛可经休息、或含化硝酸甘油后迅速缓解（C错）。初发型劳累性心绞痛指病人过去未发生过心绞痛或心肌梗塞，而现在发生由心肌缺血缺氧引起的心绞痛，时间尚在1～2个月内（D错）。急性心肌梗死约半数以上的急性心肌梗死患者，在起病前1～2天或1～2周有前驱症状，最常见的是原有的心绞痛加重，发作时间延长，或对硝酸甘油效果变差；或继往无心绞痛者，突然出现长时间心绞痛（E错）。